下列除哪项外，均为喘证的病因
A. 外邪侵袭
B. 饮食不当
C. 情志所伤
D. 痰热素盛
E. 劳欲久病

正确答案：D。痰热素盛

解析：外感风寒，未能及时表散，内则壅遏肺气，外而郁闭皮毛，使肺气失于宣降，肺气上逆而成喘证。外感风热之邪，风热犯肺，失于疏泄，邪热壅肺，甚则热蒸液成痰，清肃失司，致肺气上逆而成喘证。外寒未解，内已化热，热不得泄，为寒所郁，则肺失宣降，气逆而成喘证，故外邪侵袭为喘证的病因（A错）。饮食不当，脾失健运，蕴生痰浊，上干于肺，壅阻肺气，气机不利，升降失常，而成喘证（B错）。情志不遂，忧郁伤肝，肝失条达，气失疏泄，肺气闭阻或郁怒伤肝，肝气上逆乘肺，肺失肃降，升多降少，气逆而喘（C错）。痰热素盛，薰灼于肺，致热盛血瘀，蕴酿成痈，而成肺痈（D对）。久病肺弱，咳伤肺气，或中气虚弱，肺气失于充养，肺之气阴不足，则气失所主而发为喘证；肺病日久，肺之气阴耗伤，不能下萌于肾，则肺虚及肾，或劳欲伤肾，精气内夺，伤及真元，根本不固，则气失摄纳，上出于肺，出多入少，逆气上奔而成喘证，故劳欲久病为喘证的病因（E错）。